既开窍宁神，又化湿和胃的药是
A. 广藿香
B. 石菖蒲
C. 苏合香
D. 安息香
E. 小茴香

正确答案：B。石菖蒲

解析：本题考查的是石菖蒲的功效。既开窍宁神，又化湿和胃的药是石菖蒲（B对）。石菖蒲：【功效】开窍宁神，化湿和胃。广藿香（A错）：【功效】化湿，止呕，发表解暑。苏合香（C错）：【功效】开窍辟秽，止痛。安息香（D错）：【性味归经】辛、苦，平。归心、脾经。【功效】开窍辟秽，行气活血，止痛。【主治病证】（1）闭证神昏。（2）心腹疼痛。（3）产后血晕，痹痛日久。小茴香（E错）：【性味归经】辛，温。归肝、肾、脾、胃经。【功效】散寒止痛，理气和胃。【主治病证】（1）寒疝腹痛，睾丸偏坠胀痛，经寒痛经。（2）胃寒呕吐，寒凝气滞之脘腹胀痛。